固本咳喘片的功效是
A. 益气补肺，止嗽定喘
B. 补肾纳气，涩精止遗
C. 益气固表，健脾补肾
D. 滋阴清肺，止咳平喘
E. 清肺润燥，化痰止咳

正确答案：C。益气固表，健脾补肾

解析：本题考查的是固本咳喘片的功能。固本咳喘片的功效是益气固表，健脾补肾（C对）。固本咳喘片：【功能】益气固表，健脾补肾。人参保肺丸：【功能】益气补肺，止嗽定喘（A错）。七味都气丸：【功能】补肾纳气，涩精止遗（B错）。蛤蚧定喘丸：【功能】滋阴清肺，止咳平喘（D错）。二母宁嗽丸：【功能】清肺润燥，化痰止咳（E错）。